可诱导机体产生免疫耐受的抗原称为
A. 半抗原
B. 变应原
C. 耐受原
D. 超抗原
E. 丝裂原

正确答案：C。耐受原